影响药物排泄的中西药联用药组是
A. 风痛药酒与二甲双胍
B. 牛黄解毒片与利福平
C. 银杏叶胶囊与地高辛
D. 补中益气丸与环磷酰胺
E. 大山楂丸与阿司匹林

正确答案：E。大山楂丸与阿司匹林

解析：本题考查的是中西药联用在药动学上的相互作用。影响药物排泄的中西药联用药组是大山楂丸与阿司匹林（E对）。含有机酸成分的中药，如乌梅、山茱萸、陈皮、木瓜、川芎、青皮、山楂、女贞子等与磺胺类药物、利福平、阿司匹林等酸性药物合用时，因尿液酸化，可使磺胺类药物的溶解性降低，导致尿中析出结晶，引起结晶尿或血尿，增加磺胺类药物的肾毒性；可使利福平和阿司匹林的排泄减少，加重肾脏的毒副作用。风痛药酒与二甲双胍（A错）联用影响代谢。中药酒剂、酊剂中含有一定浓度的乙醇，乙醇是常见的酶促剂，它能使肝药酶活性增强，在与苯巴比妥、苯妥英钠、安乃近、利福平、二甲双胍、胰岛素等药酶诱导剂合用时，使上述药物在体内代谢加速，半衰期缩短，药效下降；当与三环类抗抑郁药盐酸氯米帕明、丙米嗪、阿米替林及多塞平等配伍使用时，由于肝药酶的诱导作用，使代谢产物增加，从而增加三环类抗抑郁药物的不良反应。牛黄解毒片与利福平（B错）联用影响吸收。含鞣质较多的中药有大黄、虎杖、五倍子、石榴皮等，因此中成药牛黄解毒片（丸）、麻仁丸、七厘散等不宜与口服的红霉素、士的宁、利福平等同用，因为鞣质具有吸附作用，使这些西药透过生物膜的吸收量减少。银杏叶胶囊与地高辛（C错）联用影响分布。银杏叶与地高辛合用可促进主动脉内皮细胞内Ca²⁺水平升高，使地高辛的游离血药浓度明显升高，易造成中毒，因此，临床上两者联合使用时应适当降低地高辛剂量，并进行血药浓度的监测。补中益气丸与环磷酰胺（D错）联用后的效果，2022年考试指南未明确说明。